下列哪项是用来说明某事物内部各构成部分所占的比重的
A. 可信区间
B. 标准误
C. 标准差
D. 平均数
E. 构成比

正确答案：E。构成比

解析：构成比：是用来说明某事物内部各构成部分所占的比重。掌握“口腔健康状况调查数据的整理和统计”知识点。